某患者，患乙型肝炎多年，近日病情加重，形成暴发性肝炎，试问该患可能是合并哪种病毒的重叠感染
A. HAV
B. HCV
C. HDV
D. HEV
E. CMV

正确答案：C。HDV

解析：HDV为缺陷性病毒，故HDV必须有HBV相辅助，即混合感染，才能感染人体。混合感染分为联合感染（或称同时感染）和重叠感染。掌握“丙型、丁型、戊型肝炎病毒”知识点。